《中国人民共和国药品管理法实施条例》规定对药品生产企业生产的新药品种设立的监测期不超过
A. 1年
B. 3年
C. 4年
D. 5年
E. 6年

正确答案：D。5年

解析：本题考查药品管理。《中国人民共和国药品管理法实施条例》规定对药品生产企业生产的新药品种设立的监测期不超过5年（D对）；在监测期内，不得批准其他企业生产和进口。